患者，男，肛门左侧皮下有一肿物5天，焮红热痛，按之应指。其诊断是
A. 坐骨直肠间隙脓肿
B. 骨盆直肠间隙脓肿
C. 直肠后间隙脓肿
D. 肛旁皮下间隙脓肿
E. 直肠脱出嵌顿

正确答案：D。肛旁皮下间隙脓肿

解析：患者肛门左侧皮下即可看见有一肿物，焮红热痛，按之应指，全身症状轻微，符合肛门左侧皮下间隙脓肿的诊断（D对）。坐骨直肠间隙脓肿全身症状明显，发于肛门与坐骨结节之间，位置较深，肛门指诊患侧饱满，有明显的压痛和波动感（A错）。骨盆直肠间隙脓肿局部症状不明显，全身症状明显，肛门指诊可触及患侧直肠壁处隆起、压痛及波动感（B错）。直肠后间隙脓肿症状与骨盆直肠问隙脓肿相同，但直肠内有明显的坠胀感，肛门指诊直肠后方肠壁处有触痛、隆起和波动感（C错）。直肠脱出嵌顿可见肛门处有坚实的直肠脱出物，伴有疼痛难忍，严重者甚则可导致直肠坏死（E错）。